普鲁卡因不可用于哪一种局麻
A. 蛛网膜下腔麻醉
B. 表面麻醉
C. 浸润麻醉
D. 传导麻醉
E. 硬膜外麻醉

正确答案：B。表面麻醉